患者呕吐大量隔宿食物，且常在晚间发生。查体：上腹中部膨胀，并见胃型。应首先考虑的是
A. 胆石症
B. 肝硬化
C. 胃肿瘤
D. 幽门梗阻
E. 肝囊肿

正确答案：D。幽门梗阻

解析：幽门梗阻可分为功能性和器质性梗阻两类。前者见于溃疡活动期，由于溃疡周围组织充血。水肿或反射性痉挛所致，内科治疗有效，溃疡控制后可消失。后者由于溃疡反复发作，疤痕形成所致，需外科治疗。幽门梗阻引起胃内容物滞留，临床表现为上腹饱胀不适，餐后明显，呕吐胃内容物，量多，呕吐后反感舒服，可引起失水。低氮低钾性碱中毒、营养不良和体重下降。上腹部空腹振水音和胃蠕动波波是幽门梗阻的典型特征，根据患者症状，可诊断为幽门梗阻（D对）。胆石症（A错）主要表现为右上腹绞痛，并向背部放射。肝硬化（B错）主要表现为肝功能减退和门静脉高压的特点。胃肿瘤（C错）常有呕血、黑便，消瘦乏力的表现。肝囊肿（E错）有消化不良，肝功能减退，和发热的感染表现。